下列各项易导致妇产科疾病发生的是
A. 风、寒、湿
B. 风、湿、热
C. 寒、热、湿
D. 寒、暑、热
E. 寒、湿、燥

正确答案：C。寒、热、湿

解析：引起妇科疾病的原因有很多，包括淫邪因素、情志因素和环境因素等等。风、寒、暑、湿、燥、火是自然界的气候变化，正常情况下为“六气”。若非其时有其气则成为致病因素，称为“六淫邪气”。各种淫邪因素皆可导致妇科疾病的发生。但由于妇女的经、孕、胎、产均以血为用，而寒、热、湿邪尤易与血相搏而致病，故妇科疾病中以寒、热、湿邪较为常见（C对）。